具有血管紧张素Ⅰ转换酶抑制作用，能防止和逆转心室肥厚的药物是
A. 地高辛
B. 氨茶碱
C. 卡托普利
D. 肼屈嗪
E. 硝普钠

正确答案：C。卡托普利